大输液质量要求包括
A. 不得加有任何抑菌剂
B. 无热原
C. 澄明度
D. 渗透压
E. pH值

正确答案：A、B、C、D、E。不得加有任何抑菌剂；无热原；澄明度；渗透压；pH值

解析：本题考查大输液的质量要求。输液的质量要求与注射剂基本上是一致的。但由于输液的注射量大，直接注入血液循环，因而质量要求更严格。无菌、无热原（B对）或细菌内毒素、不溶性微粒（C对）等项目必须符合规定，pH（E对）与血液相近；渗透压（D对）应为等渗或偏高渗；不得添加任何抑菌剂（A对），并在贮存过程中质量稳定；使用安全，不引起血液一般检测或血液常规检测的任何变化，不引起变态反应，不损害肝、肾功能。